2岁女孩，突起发热，伴咽痛，稀便3～4次／天，3天后热退，间隔2天又发热伴头痛多汗，全身肌肉疼痛，持续3天热退，继之出现右下肢无力肌张力减退膝反射消失。应诊断为
A. 风湿性关节炎
B. 类风湿性关节炎
C. 脊髓灰质炎
D. 化脓性关节炎
E. 结核性关节炎

正确答案：C。脊髓灰质炎

解析：患儿，第2次发热持续3天后出现右下肢（不对称性肌群无力）无力肌张力减退膝反射消失，符合脊髓灰质炎的特点，应诊断为脊髓灰质炎（C对）。风湿性关节炎（A错）、类风湿性关节炎（B错）、化脓性关节炎（D错）都会变现为受累关节的疼痛，而不是表现为肌肉疼痛和肌无力。结核性关节炎（E错）一般是继发于肺结核，会有低热、盗汗、体重下降的典型表现，因此不能诊断为结核性关节炎。